关于生长发育的一般规律的错误论述是
A. 生长发育过程是一个连续性过程
B. 生长发育过程具有阶段性
C. 各系统的发育过程平稳而协调
D. 生长发育速度呈波浪形
E. 儿童个体生长发育呈现出一定的轨迹现象

正确答案：C。各系统的发育过程平稳而协调

解析：本题考查生长发育的一般规律。儿童时期各器官系统发育先后、快慢不一，即发育不平衡（C错，为本题正确答案）。生长发育的一般规律是：1.生长的连续性（A对）、非匀速性、阶段性（B对）：整个儿童期体格生长速度曲线呈一个横“S”形”（D对）；2.生长的程序性：儿童时期各器官系统发育先后、快慢不一，即发育不平衡，也遵循生长程序性的规律（E对）；3.个体差异：生长发育虽然按一定的总规律发展，但在一定范围内受遗传与环境的影响。